乳癖的特点是
A. 乳块肿痛，皮色微红，按后痛甚
B. 乳块皮肉相连，溃破脓稀薄如痰
C. 乳块呈卵圆形，表面光滑，推之活动
D. 乳块质地较软，月经后缩小
E. 肿块高低不平，质硬，推之不动

正确答案：D。乳块质地较软，月经后缩小

解析：本题考查乳房疾病的临床特点。乳癖的特点是单侧或双侧乳房疼痛并出现肿块，乳痛和肿块与月经周期及情志变化密切相关。乳房肿块大小不等，形态不一，边界不清，质地不硬，活动度好，且经后可稍见变小变软（D对）。乳块肿痛，皮色微红，按后痛甚是乳痈的临床特点（A错）。乳块皮肉相连，溃破脓稀薄如痰是乳痨的临床特点（B错）。乳块呈卵圆形，表面光滑，推之活动是乳核的临床特点（C错）。肿块高低不平，质硬，推之不动是乳岩的临床特点（E错）。